正确描述动脉韧带的是
A. 连于肺动脉与升主动脉之间
B. 由肌纤维束构成
C. 位于肺动脉与主动脉之间
D. 来源于动脉圆锥
E. 是胎儿时期动脉导管闭锁的遗迹

正确答案：E。是胎儿时期动脉导管闭锁的遗迹

解析：动脉韧带为连于肺动脉干分叉处稍左侧至主动脉弓下缘（AC错）的纤维性结缔组织索（B错）。是胎儿时期动脉导管（D错）闭锁的遗迹（E对）。